关于梅毒病原体描述正确的是
A. 为兼性厌氧微生物
B. 梅毒病原体是苍白支原体
C. 离开人体后仍可存活数周
D. 普通消毒剂可迅速将其杀灭
E. 低温环境可迅速杀灭该病原微生物

正确答案：D。普通消毒剂可迅速将其杀灭

解析：梅毒病原体是苍白密螺旋体，为厌氧微生物，离开人体后不易存活。煮沸、干燥、日光、肥皂水和普通消毒剂可迅速将其杀灭。耐寒力强，4℃时可存活3天，-78℃条件下保存数年仍具有传染性。掌握“梅毒的口腔表征”知识点。